我国人群伤害的第一位死因是
A. 溺水
B. 跌倒
C. 中毒
D. 医疗事故
E. 道路交通伤害

正确答案：E。道路交通伤害